患儿，第一胎足月顺产，生后3天。生后12小时发现皮肤黄染，持续未消退。吃奶好。体格检查：体温正常，一般情况好，皮肤巩膜中度黄染，肝肋下2cm，Hb100g/L。患儿血型A型，母亲血型O型。血清胆红素257umol/L（15mg/dl）。患儿可能的诊断是
A. 新生儿败血症
B. 新生儿肝炎
C. 新生儿ABO溶血病
D. 新生儿Rh溶血病
E. 新生儿胆道闭锁

正确答案：C。新生儿ABO溶血病

解析：患儿，生后3天，第一胎足月顺产，生后12小时发现皮肤黄染，持续未消退，吃奶好（提示患儿一般情况良好），体格检查：皮肤巩膜中度黄染，肝肋下2cm（提示肝大），Hb100g/L（正常值为140～170g/L，提示患儿贫血），血清胆红素15mg/dl（正常值为5～7mg/dl，血清胆红素升高），患儿血型A型，母亲血型O型（ABO溶血的好发人群），根据患儿的临床症状、体征及实验室检查，考虑最可能的诊断为新生儿ABO溶血病（C对），该病主要表现为黄疸、贫血及肝脾大，主要发生在母亲O型而胎儿A型或B型。新生儿败血症（A错）的一般情况价差且黄疸迅速加重，或退而复现，严重时可发展为胆红素脑病。新生儿肝炎（B错）多由病毒引起的宫内感染所致。新生儿Rh溶血病（D错）一般不发生在第一胎，且一般发生在母亲血型为Rh阴性，胎儿为Rh阳性的情况。新生儿胆道闭锁（E错）黄疸多在2-4周出现，大便逐渐呈灰白色，血清结合胆红素显著增高。